患者，男，60岁。脑出血后长期卧床，2天前出现发热，咳嗽，呼吸困难等症状，胸透见两肺下叶有散在的边缘不清小灶影。首先考虑的是
A. 大叶性肺炎
B. 干酪样肺炎
C. 间质性肺炎
D. 转移性肿瘤
E. 小叶性肺炎

正确答案：E。小叶性肺炎

解析：本例患者出现发热、咳嗽、呼吸困难等肺部感染症状，且有长期卧床的病史，胸透提示两肺下叶有散在的边缘不清小灶影，应首先考虑为小叶性肺炎（E对）。小叶性肺炎即支气管性肺炎，其病原体有肺炎链球菌、葡萄球菌、病毒、肺炎支原体以及军团菌等，X线影像显示为沿着肺纹理分布的不规则斑片状阴影，边缘密度浅而模糊，无实变征象，肺下叶常受累。大叶性肺炎（A错）多有上呼吸道感染的前驱症状，主要表现为发热、胸痛、咳吐铁锈色痰、肺部听诊湿啰音、呼吸困难，X线影像早期仅见肺纹理增粗，或受累的肺段、肺叶稍模糊。干酪样肺炎（B错）多发生在机体免疫力和体质衰弱，又受到大量结核分枝杆菌感染的患者，或有淋巴结支气管瘘，淋巴结中的大量干酪样物质经支气管进入肺内而发生。本例患者无相关病史，故不考虑为干酪样肺炎。间质性肺炎（C错）大多由于病毒所致，主要为腺病毒、呼吸道合胞病毒、流感病毒等，常形成坏死性支气管炎及支气管肺炎，病程迁延易演变成慢性肺炎。转移性肿瘤（D错）的X线表现最常见的是在中下野孤立性或多发性结节样病灶，直径1～2cm，边缘较光滑，随着病灶增大和增多，可相互融合成巨块。